对大连接体的要求，哪项不正确
A. 扁平形或板条形
B. 不压迫骨性突起
C. 边缘圆钝
D. 不妨碍唇颊舌活动
E. 尽量增加宽度，可保证足够强度

正确答案：E。尽量增加宽度，可保证足够强度

解析：对大连接体的要求：①有一定的强度、质地坚韧、不变形、不断裂；②不能妨碍唇、颊、舌的运动；③根据不同的位置、受力情况和组织情况，可呈不同的大小、外形和厚度，一般呈扁平形或板条形。连接杆的弹性随长度而增加。因此，若杆的长度增加，应相应地增加厚度。杆的边缘应圆钝；④不能进入软组织倒凹，以免影响义齿就位和压伤软组织。不能压迫上颌腭隆突、下颌舌隆突及其他骨性突起。掌握“局部义齿连接体”知识点。